组织严重创伤是通过
A. 激活凝血因子Ⅻ而引起DIC
B. 大量组织因子入血引起DIC
C. 血小板聚集、释放而引起DIC
D. RBC大量破坏引起DIC
E. 其他促凝物质入血引起DIC

正确答案：B。大量组织因子入血引起DIC

解析：大量组织因子入血引起DIC（B对）是组织严重创伤导致的，激活外源性凝血系统，启动凝血过程。激活凝血因子Ⅻ而引起DIC（A错）是内源性凝血系统的激活。血小板聚集、释放而引起DIC（C错）是血小板因子3 (PF2)的释放，血小板与胶原组织接触发生黏附、聚积。RBC大量破坏引起DIC（D错）是破坏的红细胞释放大量 ADP等促凝物质，促进血小板黏附、聚集，导致凝血。其他促凝物质入血引起DIC（E错）是急性坏死性胰腺炎时，大量胰蛋白酶入血，可激活凝血酶原，促进凝血酶生成。